哪一项是代谢性酸中毒的血气变化
A. AB增大
B. SB增大
C. PaC02增大
D. BB增大
E. BE负值增大

正确答案：E。BE负值增大

解析：机体发生代谢性酸中毒时，HCO₃⁻原发性减低，所以AB（A错）、SB（B错）、BB（D错）值均降低，BE负值加大（E对）， pH下降，通过呼吸代偿，PaC02 继发性下降（C错），AB<SB。